女性，55岁。因子宫癌入院准备进行全子宫切除。患者曾有输血并出现过敏反应的病史。Hb100g/L，血小板100×10⁹/L。现准备术中用血，最好是选用
A. 新鲜全血
B. 浓缩红细胞
C. 红细胞悬液
D. 洗涤红细胞
E. 红细胞悬液和血浆

正确答案：D。洗涤红细胞

解析：患者曾有输血并出现过敏反应的病史，故输入的血液成分中应尽量减少除红细胞以外的异物，以免引起新的输血反应。洗涤红细胞（D对）中主要为红细胞，仅含少量血浆、无功能白细胞及血小板，引起输血反应的可能性极低，故可在该患者术中输注。而新鲜全血（A错）、浓缩红细胞（B错）、红细胞悬液（由全血经离心移去大部分血浆后，加入红细胞保存液制备而成）（C错）及血浆（E错）中均含有抗体或白细胞、血小板等异物，有可能再次引发输血反应。